皮肤或黏膜完整性尚存的损伤称为
A. 开放性损伤
B. 闭合性损伤
C. 多发伤
D. 穿通伤
E. 枪弹伤

正确答案：B。闭合性损伤

解析：本题考查闭合性损伤。闭合性损伤（B对）为皮肤或黏膜完整性尚存的损伤。开放性损伤（A错）为皮肤或口腔黏膜完整性受到破坏的损伤。除颌面部损伤外，合并有其他部位或器官损伤称为多发伤（C错）。穿通伤（D错）是指外物从组织结构一侧进入，从另一侧穿出，贯穿整个组织结构层面所造成的损伤。枪弹伤（E错）为高速、小口径武器所致的组织结构损伤。